活血通经的药物是
A. 木通
B. 车前子
C. 益母草
D. 瞿麦
E. 地肤子

正确答案：D。瞿麦

解析：瞿麦苦寒泄降，能清心与小肠之火，导热下行，有利尿通淋之功，为治淋证之常用药；能活血通经（D对），对于血热瘀阻之经闭或月经不调尤为适宜，常与桃仁、红花、丹参等同用。